风险管理的原则应包括
A. 风险管理决策和操作过程应当保密
B. 风险管理不包括与消费者之间的互动交流
C. 风险管理不应考虑风险评估结果中的不确定性
D. 持续不断地把新数据用于对风险管理决策的评估中
E. 保护食品企业的利益是风险管理决策的首要考虑因素

正确答案：D。持续不断地把新数据用于对风险管理决策的评估中

解析：本题考查风险管理的原则。风险管理的原则包括：1.风险管理应采用系统的方法；2.保护人类健康是风险管理决策的首要考虑因素（E错）；3.风险管理决策和操作过程应当透明（A错）；4.风险评估政策的确立应是风险管理的内容之一；5.应保持风险管理和风险评估功能上的区别，从而保证风险评估过程中完整的科学性和一致性；6.风险管理应考虑风险评估结果中的不确定性（C错）；7.风险管理包括在其全过程与消费者和有关利益相关方之间明晰而互动的交流（B错）；8.风险管理是一个持续的过程，需要不断地把新出现的数据用于对风险管理决策的评估和审视中（D对）。